平衡觉传导通路
A. 感受器为Corti器
B. 第一级神经元位于螺旋神经节
C. 纤维经小脑下脚止于旧小脑
D. 刺激时引起眩晕、恶心、呕吐
E. 与旧小脑功能有关

正确答案：D。刺激时引起眩晕、恶心、呕吐

解析：平衡觉传导通路的第1级神经元是前庭神经节内的双极神经元（A错），感受器为内耳半规管的壶腹崝及前庭内的球囊斑和椭圆囊斑（B错）。而前庭神经外侧核的纤维经小脑下脚止于原小脑（C错），与原小脑功能有关（E错）。刺激时引起眩晕、恶心、呕吐（D对）。